治疗癫痫小发作宜选用的药物是
A. 扑米酮
B. 苯妥英钠
C. 地西泮（静脉注射）
D. 乙琥胺
E. 卡马西平

正确答案：D。乙琥胺

解析：本题考查抗癫痫药的选用。癫痫小发作又称为典型失神性发作，首选药物为乙琥胺（D对）。